心绞痛发作时，首选的速效药物是
A. 普萘洛尔（心得安）
B. 硝苯地平（心痛定）
C. 硝酸异山梨醇酯（消心痛）
D. 硝酸甘油
E. 阿司匹林

正确答案：D。硝酸甘油

解析：临床上心绞痛发作时，首选速效的硝酸酯制剂，这类药除扩张冠状动脉、增加冠状循环的血流量外，还可扩张周围血管，减低心脏前后负荷和心肌的需氧，从而缓解心绞痛。常用硝酸甘油，可用0.3～0.6mg，舌下含化，1～2分钟开始起作用，约半小时后作用消失（D对）。普萘洛尔（心得安）（A错）、硝苯地平（心痛定）（B错）有降低心率，减少心脏耗氧的作用，硝酸异山梨醇酯（消心痛）（C错）、阿司匹林（E错）有扩张冠脉，抗血小板凝集的作用，均用于心绞痛缓解期的治疗，并防止心绞痛的发作，有利于远期预后。